下列影响老年人血药浓度的因素中，叙述错误的是
A. 心肝肾及胃肠道等主要器官功能在不断下降
B. 常规剂量连续给药就有可能引起蓄积性中毒
C. 与血浆蛋白的结合率增加，使游离型药物减少
D. 对药物的代谢、排泄减慢，血浆半衰期延长
E. 即使在常规剂量下，也可能出现血药浓度增高而造成毒性反应

正确答案：C。与血浆蛋白的结合率增加，使游离型药物减少

解析：本题考查影响老年人血药浓度的因素。老年人血浆白蛋白浓度降低，导致药物蛋白结合率下降，使游离药物浓度增加，作用增强（C错，为本题正确答案）。年龄的增长导致机体内环境改变，心肝肾及胃肠道等主要器官功能下降（A对）。老年人肝血流量减少，肝微粒体酶系的活性降低，导致肝脏代谢药物能力下降，药物血浆半衰期延长（D对）。同时，老年人肾功能减退，一些主要经肾脏排泄的药物或活性代谢产物在常规剂量连续给药就有可能引起蓄积性中毒（B对），常规剂量下可能出现血药浓度增高而造成毒性反应（E对）。